女，38岁，已婚，右乳外上象限可触及一直径3cm包块，同侧腋窝触到肿大淋巴结，其它器官系统未见异常若体检结果为T2N1M0，按TNM分期法应属于
A. 0期
B. Ⅰ期
C. Ⅱ期
D. Ⅲ期
E. Ⅳ期

正确答案：C。Ⅱ期

解析：根据国际抗癌协会建议的TNM分期标准，乳腺癌可分为以下各期：0期：TisN0M0；Ⅰ期：T1N0M0；Ⅱ期（C对）：T0～1N1M0，T2N0～1M0，T3N0M0；Ⅲ期：T0～2N2M0，T3N1～2M0，T4任何NM0，任何TN3M0；Ⅳ期：包括M1的任何TN。